气管和主支气管是连接喉与肺之间的管道，以“C”形透明软骨环为支架，管壁一般分为黏膜、黏膜下层和外膜3层结构。为何异物坠入时，多进入右肺
A. 右主支气管细而短
B. 右主支气管粗而短
C. 右主支气管细而长
D. 右主支气管粗而长
E. 右主支气管较倾斜

正确答案：B。右主支气管粗而短

解析：右主支气管粗而短，所以异物坠入时，多进入右肺（B对）。